医疗机构应当设置电离辐射醒目警示标志的场所是
A. 放射性工作人员办公室
B. 放射性检查报告单发放处
C. 接受放射诊疗患者的病房
D. 医学影像科候诊区
E. 放射性废物储存场所

正确答案：E。放射性废物储存场所

解析：医疗机构应当对下列设备和场所设置醒目的警示标志：①装有放射性同位素和放射性废物的设备、容器，设有电离辐射标志；②放射性同位素和放射性废物储存场所（E对），设有电离辐射警告标志及必要的文字说明；③放射诊疗工作场所的入口处，设有电离辐射警告标志；④放射诊疗工作场所应当按照有关标准的要求分为控制区、监督区，在控制区进出口及其他适当位置，设有电离辐射警告标志和工作指示灯。